双端固定桥固位不良的原因有
A. 固位体的设计不当，固位力不足
B. 两端的基牙数目不等
C. 基牙制备时，轴面聚合度过小
D. 桥体强度不足
E. 一端固位体的固位力略高于另一端

正确答案：A。固位体的设计不当，固位力不足

解析：本题考查影响固定局部义齿固位的因素。固定桥的固位力主要依靠摩擦力、粘接力和约束力的协同作用，固位力大小与基牙冠部形态和结构、固位体的选择和设计有关，固位体的设计不当，固位力不足（A对）会引起双端固定桥固位不良。两端的基牙数目不等（B错）、一端固位体的固位力略高于另一端（E错）可引起固定桥的翘动，引起义齿不稳定。基牙预备时，轴面聚合度过小（C错）有利于增强固位力。而桥体强度不足（D错）可引起固定桥的损坏，但不是引起双端固定桥固位不良的原因。